男，70岁。右腹股沟区可复性肿物15年。查体：P84次/分，R20次/分，BP160/110mmHg。糖尿病病史7年，口服降糖药治疗，空腹血糖近1个月来维持在6.2～9.0mmol/L。吸烟20余年，20～30支/日。欲行右腹股沟无张力疝修补术，围手术期处理错误的是
A. 术前戒烟2周
B. 练习床上排便
C. 术前应用胰岛素降低血糖
D. 术前禁食12小时
E. 口服降压药控制血压

正确答案：C。术前应用胰岛素降低血糖

解析：患者欲行右腹股沟无张力疝修补术，为择期手术。术前应充分评估患者，在术前纠正各种问题，以提高患者的手术耐受力。患者长期吸烟史，术前戒烟2周（A对）能减轻气道的炎症反应、减少黏液分泌，保证手术过程中的呼吸道通畅。术前练习床上排便（B对）为手术前的适应性锻炼，可以帮助患者更好适应术后变化。糖尿病患者术前血糖控制在轻度升高状态（5.6～11.2mmol/L）较为适宜，既不至于因胰岛素过多而发生低血糖，也不至于因胰岛素过少而发生酮症酸中毒。该患者空腹血糖近1个月来维持在6.2～9.0mmol/L，因此无需应用胰岛素降低血糖，只需服用常规降糖药至术前一天晚上（C错，为本题正确答案）。术前禁食12小时（D对），做好胃肠道准备，以防因麻醉或手术过程中的呕吐而引起窒息或吸入性肺炎。高血压患者应继续服用降压药物，避免戒断综合征。病人血压在160/100mmHg以下时，可不必作特殊准备。血压过高者（大于180/100mmHg），术前应选用合适的降压药物，使血压平稳在一定水平，但不要求降低至正常后才做手术。本例患者血压为160/110mmHg，口服降压药控制血压（E对）即可，不必在术前应用静脉药物。